按儿童的计划免疫要求，儿童在一岁半内应完成下列哪项生物制品接种
A. 卡介苗，百日咳菌苗，麻疹，脊髓灰质炎疫苗
B. 百日咳菌苗，麻疹，脊髓灰质炎疫苗，白喉类毒素
C. 麻疹，脊髓灰质炎疫苗，白喉，破伤风类毒素
D. 脊髓灰质炎疫苗，白喉，破伤风类毒素，卡介苗
E. 卡介苗，百白破，脊髓灰质炎疫苗和麻疹疫苗

正确答案：E。卡介苗，百白破，脊髓灰质炎疫苗和麻疹疫苗

解析：本题考查免疫程序。按儿童的计划免疫要求，儿童在一岁半内应完成卡介苗，百白破，脊髓灰质炎疫苗和麻疹疫苗接种（E对ABCD错）。